现有60例心脏移植患者，随访观察其术后5年存活情况，其中2例由于迁居国外而失访，36例在随访结束时存活，而20例在随访期中由于心脏原因发生死亡，2例由于意外事故发生死亡。上述实例中，发生感兴趣终点事件的人数为
A. 2例
B. 58例
C. 22例
D. 20例
E. 36例

正确答案：D。20例

解析：本题考查终点事件的概念。终点事件指标志某种处理措施失败或失效的特征事件。本题研究的是心脏移植患者随访观察术后5年的存活情况,在随访期中由于心脏原因发生死亡属于终点事件，有20（D对ABCE错）例。